妊娠期禁用峻下、破血、有毒药物，属于
A. 阳虚寒凝
B. 津亏血燥
C. 脾肾两虚
D. 脾胃虚寒
E. 气机壅滞

正确答案：C。脾肾两虚